李某，男，患肺痨1年，见干咳少痰，痰中带血，胸痛，潮热颧红，咽干口燥，舌红，苔薄黄少津，脉细数，应选方
A. 清燥救肺汤
B. 沙参麦冬汤
C. 百合固金汤
D. 月华丸
E. 保真汤

正确答案：C。百合固金汤

解析：题中患者为肺痨。肺病及肾，肺肾阴伤，虚火内灼，炼津成痰，故干咳少痰；虚火灼伤血络，故痰中带血；肝肺脉络不和，乃致胸痛；热邪耗伤津液则咽干口燥；阴虚阳浮，水亏火旺，故潮热颧红；舌红，苔薄黄少津，脉细数为阴虚燥热内盛之象，故诊断为虚火灼肺证，治疗应用百合固金汤合秦艽鳖甲散，滋阴降火（C对）。清燥救肺汤养阴润燥，清金降火，用于阴虚燥火内盛，干咳痰少，咽痒气逆（A错）。沙参麦冬汤滋阴润肺，化痰止咳，为肺阴亏损证之咳嗽的代表方（B错）。月华丸滋阴润肺，为肺阴亏损证之肺痨的代表方（D错）。保真汤益气养阴，为气阴耗伤证之肺痨的代表方（E错）。